痈常见于
A. 心脏病人
B. 高血压病人
C. 肺结核病人
D. 糖尿病病人
E. 肾炎病人

正确答案：D。糖尿病病人

解析：本题考查软组织急性感染。痈一般以中、老年发病居多，部分病人有糖尿病（D对）。